不是Ⅰ型超敏反应特点是
A. IgE介导
B. 发生速度快
C. 有明显的个体差异
D. 引起功能紊乱
E. 造成严重组织细胞损伤

正确答案：E。造成严重组织细胞损伤